消化性溃疡合并出血常见于
A. 胃溃疡
B. 急性胃黏膜病变
C. 十二指肠球部溃疡
D. 胃癌
E. 慢性胃炎

正确答案：C。十二指肠球部溃疡

解析：消化性溃疡中，十二指肠溃疡较胃溃疡多见，出现出血并发症的部位十二指肠更常见，十二指肠溃疡出血最常见的部位是球部后壁，十二指肠溃疡穿孔最常见于球部前壁。